能够诱导UDP-葡糖醛酸基转移酶合成从而减轻黄疸的药物是
A. 苯巴比妥
B. 磺胺嘧啶
C. 氢氯噻嗪
D. 青霉素
E. 阿司匹林

正确答案：A。苯巴比妥

解析：苯巴比妥（A对）是肝脏UDP-葡萄糖醛酸转移酶的诱导剂，UDP-葡萄糖醛酸转移酶可以降低血中未结合胆红素浓度，使黄疸减轻或消失，而缩短黄疸期。磺胺嘧啶（B错）作为二氢叶酸合成酶的竞争性抑制剂，达到阻碍叶酸合成的效果，属于磺胺类广谱抗菌药。氢氯噻嗪（C错）属于利尿剂，主要用于高血压和尿崩症的治疗。青霉素（D错）为广谱抗菌药，主要用于细菌感染的治疗。阿司匹林（E错）为解热镇痛药，并且有抑制血小板聚集的作用，用于预防心肌梗死的复发。